决定药物游离型和结合型浓度的比例，既可影响药物体内分布也能影响药物代谢和排泄的因素是
A. 血浆蛋白结合率
B. 血脑屏障
C. 肠肝循环
D. 淋巴循环
E. 胎盘屏障

正确答案：A。血浆蛋白结合率

解析：本题考查血浆蛋白结合率。决定药物游离型和结合型浓度的比例，既可影响药物体内分布也能影响药物代谢和排泄的因素是血浆蛋白结合率（A对）；血脑屏障（B错）是血液与脑组织之间的屏障，选择性筛选药物；肠肝循环（C错）是经胆汁或部分经胆汁排入肠道的药物,在肠道中又重新被吸收,经门静脉又返回肝脏的现象；淋巴循环（D错）可影响脂肪、蛋白质等大分子物质转运，可使药物避免肝脏首过效应而影响药物分布。胎盘屏障（E错）是由胎盘绒毛与子宫血窦构成的，将母体与胎儿血液隔开的屏障。